某男，45岁。因肝气郁结导致胁痛、痢疾，症见脘腹胁痛，热厥手足不温，泻痢下重。治当透解郁热，疏肝理脾，宜选用的成药是
A. 四逆散
B. 逍遥丸
C. 小柴胡颗粒
D. 柴胡舒肝丸
E. 气滞胃痛颗粒

正确答案：A。四逆散

解析：本题考查的是四逆散的功能。因肝气郁结导致胁痛、痢疾，症见脘腹胁痛，热厥手足不温，泻痢下重。治当透解郁热，疏肝理脾，宜选用的成药是四逆散（A对）。四逆散：【功能】透解郁热，疏肝理脾。逍遥丸（B错）：【功能】疏肝健脾，养血调经。小柴胡颗粒（C错）：【功能】解表散热，疏肝和胃。柴胡舒肝丸（D错）：【功能】疏肝理气，消胀止痛。气滞胃痛颗粒（E错）：【功能】疏肝理气，和胃止痛。